阿司匹林的镇痛作用机制主要是
A. 抑制外周前列腺素的合成
B. 不影响P物质的释放
C. 阻断痛觉神经冲动的传导
D. 直接作用于痛觉感受器，降低其对致痛物质的敏感性
E. 抑制中枢神经系统，引起痛觉消失

正确答案：A。抑制外周前列腺素的合成

解析：本题考查阿司匹林。阿司匹林属于非甾体抗炎药（NSAID），主要是通过抑制环氧酶，从而抑制前列腺素的合成（A对）。